患者，男，60岁。平素短气息促，动则为甚，吸气不利，腰酸腿软，脑转耳鸣，劳累后哮喘易发面色苍白，舌淡苔白，质胖嫩，脉象沉细。治疗应首选
A. 射干麻黄汤
B. 定喘汤
C. 玉屏风散
D. 六君子汤
E. 金匮肾气丸

正确答案：E。金匮肾气丸

解析：哮喘病肾虚典型症状短气息促，动则为甚，吸气不利，腰酸腿软劳累后哮喘易发，治疗可用金匮肾气丸（E对）。寒哮证症状：呼吸急促，喉中哮鸣有声，胸膈满闷如塞；咳不甚，咯吐不爽，痰稀薄色白，面色晦滞带青，形寒畏冷；初起多兼恶寒、发热、头痛等表证。舌苔白滑，脉弦紧或浮紧。治法：温肺散寒，化痰平喘。方药：射干麻黄汤加减（A错）。热哮证症状：气粗息涌，咳呛阵作，喉中哮鸣，汗出口渴喜饮，面赤口苦，咳痰色黄黏浊稠厚，咯吐不利，不恶寒。舌质红，苔黄腻，脉滑数或弦滑。治法：清热宣肺，化痰定喘。方药：定喘汤加减（B错）。肺虚证症状：喘促气短，语声低微，面色皖白，自汗畏风；咳痰清稀色白，多因气候变化而诱发，发前喷嚏频作，鼻塞流清涕。舌淡苔白，脉细弱或虚大。治法：补肺固卫。方药：玉屏风散加味（C错）。脾虚证症状：倦息无力，食少便溏，面色萎黄无华；痰多而黏，咯吐不爽，胸脘满闷，恶心纳呆；或食油腻易腹泻，每因饮食不当而诱发。舌质淡，苔白滑或腻，脉细弱。治法：健脾化痰。方药：六君子汤加味（D错）。